前药修饰在药物研究开发中的主要用途有
A. 增加药物溶解度
B. 改善药物吸收和分布
C. 增加药物的化学稳定性
D. 减低毒性或不良反应
E. 延长药物的作用时间

正确答案：A、B、C、D、E。增加药物溶解度；改善药物吸收和分布；增加药物的化学稳定性；减低毒性或不良反应；延长药物的作用时间